抑制磷酸二酯酶，减少cAMP的降解而使cAMP增多的药物是
A. 二丙酸氯地米松
B. 异丙阿托品
C. 氨茶碱
D. 异丙肾上腺素
E. 特布他林

正确答案：C。氨茶碱